办理根据《麻醉药品、第一类精神药品购用印鉴卡》变更事项的受理部门是
A. 设区的市级药品监督管理部门
B. 设区的市级卫生行政部门
C. 省级药品监督管理部门
D. 省级卫生行政部门
E. 国务院卫生行政部门

正确答案：B。设区的市级卫生行政部门

解析：本题考查印鉴卡管理。办理根据《麻醉药品、第一类精神药品购用印鉴卡》变更事项的受理部门是设区的市级卫生行政部门（B对）。当《印鉴卡》中医疗机构名称、地址、医疗机构法人代表（负责人）、医疗管理部门负责人、药学部门负责人、采购人员等项目发生变更时，医疗机构应当在变更发生之日起3日内到市级卫生健康主管部门办理变更手续。